椎管内蛛网膜下隙下端一般位于
A. 第l腰椎下缘
B. 第4骶椎水平
C. 第2腰椎下缘
D. 第3骶椎水平
E. 无上述情况

正确答案：D。第3骶椎水平

解析：第一腰椎以下已无脊髓，所以椎管内蛛网膜下隙下端一般位于第3骶椎水平（D对）。